豆类的安全水分是
A. 10%～13%
B. 10%～15%
C. 12%～14%
D. 15%～18%
E. 16%～20%

正确答案：A。10%～13%

解析：本题考查豆类的安全水分。豆类的安全水分是10%～13%（A对BCDE错）。